急性牙髓炎疼痛不能定位，临床上常用的定位检查的方法为
A. 探诊
B. 叩诊
C. 冷热诊
D. 电活力测试
E. X线检查

正确答案：C。冷热诊

解析：牙髓温度测试法：正常牙髓对20～50℃接近口温的水不感到疼痛，10～20℃的冷水和50～60℃的热水很少引起疼痛，故以低于10℃为冷刺激，高于60℃为热刺激。牙髓有病变时，对冷热刺激可能表现敏感或迟钝，先测对照牙，再测患牙，无论冷诊法或热诊法，测试部位均应在牙齿的唇面或颊面中1/3处，因该处釉质较完整，引起反应有可比性。掌握“可复性、急慢性牙髓炎”知识点。